浙贝母除清热化痰外，又能
A. 消肿散结
B. 宣散风热
C. 平肝镇惊
D. 清心定惊
E. 开宣肺气

正确答案：A。消肿散结

解析：本题考查浙贝母的功效。浙贝母除清热化痰外，又能消肿散结（A对）。浙贝母【功效】清热化痰，散结消肿。前胡【功效】降气祛痰，宣散风热（B错）。礞石【功效】消痰下气，平肝镇惊（C错）。天竺黄【功效】清热化痰，清心定惊（D错）。桔梗【功效】宣肺（E错），利咽，祛痰，排脓。